在饭前半小时服用的是
A. 泻药与雌激素
B. 喹诺酮类抗菌药
C. 四环素类抗生素
D. 氨基糖苷类抗生素
E. 胃动力药

正确答案：E。胃动力药

解析：本题考查药品服用的适宜时间。促胃肠动力药（E对）多为饭前30分钟服用，患者进餐时，药物在体内的血药浓度正好达到高峰。泻药有的饭前服用，也有饭后服用的，而雌激素不作要求（A错）。抗生素（BCD错）饭后服用有助于减少胃肠道刺激。